土霉素结构中不稳定的部位为
A. 2位-CONH₂
B. 3位烯醇-OH
C. 5位-OH
D. 6位-OH
E. 10位酚-OH

正确答案：D。6位-OH

解析：本题考查土霉素。土霉素结构中不稳定的部位为6位-OH（D对ABCE错）。酸性条件下，土霉素6位羟基可和邻近氢发生反式消去反应，在碱性条件下，可和11位羰基发生亲核进攻。